硫酸镁用于治疗
A. 惊厥
B. 帕金森病
C. 抑郁症
D. 痛风
E. 记忆障碍

正确答案：A。惊厥

解析：本题考查硫酸镁的作用。硫酸镁口服给药可产生导泻和利胆作用，注射给药可产生镇静和抗惊厥（A对）作用。帕金森病（B错）治疗药物包括抗胆碱能药，金刚烷胺，复方左旋多巴，多巴胺受体激动剂，单胺氧化酶抑制剂，COMT抑制剂等。抑郁症（C错）常用药有氟西汀、帕罗西汀、舍曲林等。痛风（D错）常用药有别嘌醇、丙磺舒等。记忆障碍（E错）常用药物有石杉碱甲、银杏叶提取物等。